桑枝的功效是
A. 安胎
B. 利水
C. 解毒
D. 生津
E. 活血

正确答案：B。利水

解析：本题考查桑枝的功效。桑枝的功效是利水（B对）。桑枝【功效】祛风通络，利水。杜仲【功效】补肝肾，强筋骨，安胎（A错）。紫草【功效】凉血活血（E错），解毒（C错）透疹。生地黄【功效】清热凉血，养阴生津（D错），润肠。